桡神经沟位于
A. 肱骨上端
B. 肱骨体
C. 肱骨下端
D. 尺骨体
E. 桡骨体

正确答案：B。肱骨体

解析：桡神经沟位于肱骨体（B对）。肱骨下端有尺神经沟（C错）。